十二指肠降段腹膜后部分外伤性破裂，典型临床表现是
A. 全腹痛，明显腹膜刺激征，移动性浊音（+）
B. 全腹痛，轻度腹膜刺激征
C. 全腹痛，明显腹膜刺激征，肝浊音界消失
D. 右下腹和腰背部痛，明显腹膜刺激征，肝浊音界消失
E. 右上腹和腰背部痛，无明显腹膜刺激征

正确答案：E。右上腹和腰背部痛，无明显腹膜刺激征

解析：十二指肠可分为球部、降部、水平部和升部。降部、水平部位于腹膜后，外伤性破裂后可出现右上腹和腰背部疼痛，右上腹及腰部明显的压痛，腹膜刺激症状不明显（E对），血清淀粉酶升高；X线腹部平片可见腰大肌轮廓模糊，CT示腹膜后及右肾前间隙有气泡。球部和升部位于腹腔内（即腹膜内位器官），破裂后可有胰液和胆汁流入腹腔而早期引起腹膜炎。全腹痛，明显腹膜刺激征，移动性浊音（+）（A错）为重症胰腺炎或肝脏破裂的表现。全腹痛，轻度腹膜刺激征（B错）为脾真性破裂的表现，腹腔内大量血液，对腹膜有轻度刺激。全腹痛，明显腹膜刺激征，肝浊音界消失（C错）为胃肠道穿孔或破裂的表现。右下腹和腰背部痛，明显腹膜刺激征，肝浊音界消失（D错）为部分盲肠后位阑尾炎穿孔的表现。